关于切开拔除阻生智齿的切口设计错误的是
A. 远中切口勿偏舌侧
B. 颊侧切口与龈缘成45°角向下
C. 颊侧切口应超过前庭沟，以充分暴露视野
D. 应做黏骨膜全层切开，紧贴骨面将瓣翻起
E. 缝合后切口下应有足够骨支持

正确答案：C。颊侧切口应超过前庭沟，以充分暴露视野

解析：本题考查拔除阻生牙的切口设计。关于切开拔除阻生智齿的切口设计错误的是颊侧切口应超过前庭沟，以充分暴露视野（C错，为本题的正确答案）。颊侧切口不应为了充分暴露视野而超过前庭沟，可通过长度来获得足够的视野，若超过沟底易造成出血过多，反而影响视野。近中颊侧切口自邻牙的远中或近中颊面轴角处，与龈缘约成45°角向前下移行（B对），不要超过移行沟底。远中切口从远中龈缘正中斜向外后方，勿偏舌侧（A对），以免翻瓣不够、视野不足。黏膜和骨膜连接致密，故合称粘骨膜，应紧贴骨面将瓣翻起（D对），不可将骨膜与黏膜强力分离，否则会造成出血多，术野不清。缝合后切口下应有足够故支持（E对）。